下列指标中用于鉴别原发性与继发性甲状腺功能减退症的是
A. TSH
B. TT3
C. TT4
D. FT3
E. FT4

正确答案：A。TSH

解析：原发性甲减与继发性甲减的血甲状腺激素（FT3、FT4、TT3、TT4）水平均降低，但原发性甲减病变在甲状腺本身，血甲状腺激素降低后，甲状腺激素对于下丘脑、垂体的负反馈抑制作用减弱，引起垂体分泌TSH增多。因此其血液内分泌激素检查结果为TSH增高、TT4和FT4减低。继发性甲减病变位于腺垂体或下丘脑，血中TSH或TRH降低继发性的引起血甲状腺激素降低。因此继发性甲减血中TSH正常或减低、TT4和FT4减低。故TSH（A对）为原发性甲减与继发性甲减的鉴别点。TT4（C错）与FT4（E错）在原发性甲减与继发性甲减中均可降低，无法用于鉴别。FT3主要来源于外周组织T4的转换，其变化方向与T4相同，故TT3（B错）和FT3（D错）也不能作为鉴别条件。